男性，32岁。上夜班时突发上腹部剧烈疼痛，20分钟后疼痛波及至右下腹。检查肝浊音界消失，上腹部腹肌紧张，右下腹有明显压痛及反跳痛。该病人最可能的诊断是
A. 胃溃疡急性穿孔
B. 急性阑尾炎
C. 急性胆囊炎
D. 急性胰腺炎
E. 急性小肠梗阻

正确答案：A。胃溃疡急性穿孔

解析：青年男性患者，突发上腹部剧痛，上腹部腹肌紧张，右下腹有明显压痛及反跳痛（腹膜刺激征），检查肝浊音界消失（提示腹部空腔脏器穿孔），结合患者病史和体查，最可能的诊断为胃十二指肠溃疡急性穿孔（A对）。溃疡穿孔后消化液可沿右结肠旁沟流至右下腹，引起右下腹痛和腹膜炎体征。急性阑尾炎（B错）的腹痛发作常始于上腹，6～8小时后可转移并局限在右下腹；急性胆囊炎（C错）主要表现为右上腹绞痛或持续性疼痛伴阵发加剧，疼痛可向右肩放射，Murphy征阳性；急性胰腺炎（D错）常于饱食或饮酒后发作，腹痛多位于左上腹，可向左肩及左腰背部放射；急性小肠梗阻（E错）主要表现为腹痛、腹胀、呕吐及停止自肛门排气排便，上述疾病查体均不会出现肝浊音界消失。